自来水氟化防龋是通过调整自来水中氟浓度，使社区中每个人能从中获得预防龋病的效果。此种方法属于口腔健康促进的哪种途径
A. 共同危险因素控制途径
B. 全民途径
C. 高危人群途径
D. 决策者途径
E. 制定危险因素预防途径

正确答案：B。全民途径

解析：全民途径：在社区中开展口腔健康促进活动时，选择一种预防措施使得该社区所有人群都能从中获益。例如自来水氟化防龋，龋病是一种影响大多数人的疾病，通过调整自来水中氟的浓度达到适宜水平改变社区人们生活的环境，使社区中每个人能从自来水氟化项目中获得预防龋病的益处。掌握“口腔健康促进”知识点。